在制作面食时B族维生素损失最多的烹调方法是
A. 焖
B. 煮
C. 烙
D. 炸
E. 蒸

正确答案：D。炸

解析：本题考查制作面食时B族维生素损失最多的烹调方法。在制作面食时，一般用蒸（E错）、烤、烙（C错）的方法，B族维生素损失较少，但用高温油炸时（D对AB错）损失较大。